下列哪项不宜作为脑死亡的标准
A. 自主呼吸停止
B. 心跳停止
C. 不可逆昏迷和大脑无反应性
D. 颅神经反射消失
E. 瞳孔散大或固定

正确答案：B。心跳停止

解析：由于心肌具有自发收缩特性，在脑干死亡后的一定时间内还可能有微弱的心跳（B对）。